下列不属于临床预防服务内容的是
A. 慢性病的自我管理
B. 健康筛检
C. 化学预防
D. 健康教育
E. 免疫接种

正确答案：A。慢性病的自我管理

解析：临床预防服务的实施主体是医务人员，而慢性病的自我管理是慢性病患者的预防性干预与卫生保健活动（A错，为本题正确答案）。健康筛检指运用快速简便的测试、体格或实验室检查等方法，在健康人群中发现未被识别的可疑患者、健康缺陷者及高危个体的一项预防措施，属于第二级预防措施（B对）。化学预防指对无症状者使用药物、营养素（包括矿物质）、生物制剂或其他天然物质作为第一级预防措施，提高人群抵抗疾病的能力，防止某些疾病的发生（C对）。通过对个体进行有针对性的健康教育，提高求医者自我保健意识，并与求医者共同制定改变不良健康行为的计划，督促求医者执行干预计划等，促使他们自觉地采纳有益于健康的行为，消除或减轻影响健康的危险因素，是医务人员提供的一级预防措施（D对）。免疫接种是指将抗原或抗体注入机体，使人体获得对某些疾病的特异性抵抗力，从而保护易感人群，预防传染病发生，是针对易感人群的临床预防服务（E对）。